男，10岁，发热皮肤黏膜出血2天就诊。四肢可见出血点，肝脾不大，查血常规：血红蛋白75g/L，白细胞，血小板明显降低，外周血见幼稚细胞0.02，Ret0.02，患儿最可能的诊断是
A. 骨髓增生异常综合征
B. 再生障碍性贫血
C. 阵发性睡眠性血红蛋白尿
D. 巨幼细胞贫血
E. 急性白血病

正确答案：A。骨髓增生异常综合征

解析：患者发热皮肤黏膜出血、肝脾不大（符合骨髓增生异常综合征的临床表现），血红蛋白、白细胞、血小板明显降低，网织红细胞0.02升高（正常值0.005～0.015），外周血可见幼稚细胞（符合骨髓增生异常综合征的血象特点），考虑骨髓增生异常综合征（A对）。再生障碍性贫血（B错）也有三系细胞减少，且网织红细胞百分数多在0.005以下，且绝对值<15×10⁹/L。阵发性睡眠性血红蛋白尿（C错）典型表现为血红蛋白尿，也可出现全血细胞减少和病态造血，网织红细胞增多，但外周血无幼稚细胞。巨幼细胞性贫血（D错）呈大细胞贫血，网织红细胞计数可正常或轻度增高，重症全血细胞减少，但外周血无幼稚细胞。急性白血病（E错）发病时骨髓中异常的原始细胞及幼稚细胞（白血病细胞）大量增殖并抑制正常造血，可广泛浸润肝、脾、淋巴结等各种脏器，表现为贫血、出血、感染和浸润等征象。